关于牙外伤的危险因素，叙述正确的是
A. 碰撞
B. 交通意外
C. 运动损伤
D. 暴力
E. 以上均包括

正确答案：E。以上均包括

解析：导致牙外伤的原因有很多，其中摔倒、碰撞　摔倒、碰撞以及物体撞击到牙是发生牙外伤最常见的原因；交通意外伤害、运动损伤、暴力和行为因素也可引起牙外伤。掌握“牙外伤的预防”知识点。